采用流式细胞术鉴定的一种人外周血细胞表达CD56，这种细胞可能
A. 提呈外源性抗原
B. 杀伤肿瘤细胞
C. 吞噬细胞
D. 产生抗体
E. 表达TCR

正确答案：B。杀伤肿瘤细胞